内脏运动神经叙述错误的是
A. 低级中枢位于脊髓内
B. 也称植物性神经
C. 调节心血管运动和腺体分泌
D. 一般需经过两个神经元
E. 分为交感神经和副交感神经

正确答案：A。低级中枢位于脊髓内

解析：内在运动神经的低级中枢位于脑干的内脏运动核和脊髓T1-L3节段的灰质侧柱的中间外侧核以及第2-4节段灰质的骶副交感核（A错，为本题正确选项）。内脏运动神经调节内脏、心血管等器官的运动及腺体的分泌（C对），通常不受人的意志控制，是不随意的，故又称植物性神经（B对）。内脏运动神经自低级中枢发出后必须在周围部的内脏运动神经节（植物性神经节）交换神经元，由节内神经元再发出纤维到达效应器，因此，内脏运动神经从低级中枢到达所支配的器官须经过两个神经元（D对）。根据形态、功能和药理学的特点，内脏运动神经分为交感神经和副交感神经两部分（E对）。